9岁患儿，每晚睡前吃饼干，进来发现牙齿上有洞，但无疼痛感，前来就诊。医生还提醒其父母，要定期带其进行牙齿检查，建议
A. 每3个月1次
B. 每6个月1次
C. 每9个月1次
D. 每年1次
E. 每2年1次

正确答案：D。每年1次